下列药品零售企业的行为，不属于违反《药品经营质量管理规范》规定的是
A. 注册在某药品零售企业的执业药师，其实际工作单位为某药品批发企业
B. 某药品零售企业通过程序插件，将其阴凉陈列区的温度监测设备显示数值锁定在19℃
C. 某药品零售企业制作了提示牌“按照药品GSP的规定，非质量问题，药品一经售出，不得退换”，并将其摆放于店内醒目位置
D. 某药品零售企业购进药品不索取发票，且未配备执业药师，依然开展处方药销售活动

正确答案：C。某药品零售企业制作了提示牌“按照药品GSP的规定，非质量问题，药品一经售出，不得退换”，并将其摆放于店内醒目位置

解析：本题考查的是药品经营质量管理规范的零售主要内容。下列药品零售企业的行为，不属于违反《药品经营质量管理规范》规定的是某药品零售企业制作了提示牌“按照药品GSP的规定，非质量问题，药品一经售出，不得退换”，并将其摆放于店内醒目位置（C对）。药品零售中的药品退换：除药品质量原因外，药品一经售出，不得退换。药品零售企业（含药品零售连锁企业门店）在从事药品经营活动中，应当遵循“诚实守信、依法经营”的原则，禁止以任何弄虚作假手段骗取药品经营许可证，尤其是禁止采用聘用“挂证”执业药师骗取药品经营许可证（A错）。冷藏药品放置在冷藏设备中，按规定对温度进行监测和记录，并保证存放温度符合要求（B错）。1.药品购销要求：药品零售企业应当从合法渠道购进药品，购进药品时应当索取供货单位销售发票，做到票、账、货、款一致方可购进（D错）。